患者女，55岁。症见咳声重浊，反复发作，咳痰粘稠，色白量多，胸闷呕恶，舌苔白腻，脉濡滑。其证型是
A. 痰热郁肺
B. 痰湿蕴肺
C. 肝火犯肺
D. 寒痰阻肺
E. 燥痰伤肺

正确答案：B。痰湿蕴肺

解析：本病患者为咳嗽，脾湿生痰，上渍于肺，壅遏肺气，故咳嗽痰多，咳声重浊，痰粘腻或稠厚；脾运不健故食甘甜肥腻物品反而助湿生痰，湿痰中阻则胸闷呕恶。舌苔白腻，脉濡滑，为痰湿内盛之征，所以为痰湿蕴肺证（B对）；痰热郁肺证的症状为咳嗽气息急促，或喉中有痰声，痰多黏稠或为黄痰，咳吐不爽，或痰有热腥味，或咳吐血痰，胸胁胀满，或咳引胸痛，面赤，或有身热，口干欲饮，舌质红，舌苔薄黄腻，脉滑数（A错）；肝火犯肺证的症状为上气咳逆阵作，咳时面赤，常感痰滞咽喉，咳之难出，量少质黏，或痰如絮状，咳引胸胁胀痛，咽干口苦，症状随情绪波动而增减，性急易怒，舌红或舌边尖红，舌苔薄黄少津，脉弦数（C错）；寒痰阻肺证的症状为恶寒畏冷，咳嗽气喘，胸闷，吐白痰量多，苔白滑，脉弦紧（D错）；燥痰伤肺证的症状为咳嗽，咯痰不爽，或痰粘成块，或痰中带血，胸闷胸痛，口鼻干燥，舌干少津，苔腻，脉涩（E错）。